从生物、心理和社会等方面来观察、分析和思考，并且处理疾病和健康问题的科学观和方法论是
A. 神灵主义医学模式
B. 整体医学观
C. 生态医学模式
D. 生物-心理-社会医学模式
E. 生物医学模式

正确答案：D。生物-心理-社会医学模式